生存分析中，描述生存时间的集中趋势宜用
A. 算术平均数
B. 几何均数
C. 中位数
D. 百分位数
E. 众数

正确答案：C。中位数

解析：本题考查生存时间的集中趋势。在生存分析中，描述生存时间的集中趋势宜用中位数（C对ABDE错）。